属于莨菪烷类的生物碱是
A. 麻黄碱
B. 槲皮素
C. 小檗碱
D. 东莨菪碱
E. 青蒿素

正确答案：D。东莨菪碱

解析：本题考查的是生物碱的分类。属于莨菪烷类的生物碱是东莨菪碱（D对）。洋金花主要化学成分为莨菪烷类生物碱，由莨菪醇类和芳香族有机酸结合生成的一元酯类化合物。主要有莨菪碱（阿托品）、山莨菪碱、东莨菪碱、樟柳碱和N-去甲莨菪碱。《中国药典》以东莨菪碱为指标成分进行含量测定，要求东莨菪碱不得少于0.15%。麻黄碱（A错）为麻黄的主要化学成分，属于有机胺类生物碱。麻黄中含有多种生物碱，以麻黄碱和伪麻黄碱为主，前者占总生物碱的40%～90%，《中国药典》以盐酸麻黄碱和盐酸伪麻黄碱为指标成分进行含量测定，要求药材和饮片含盐酸麻黄碱和盐酸伪麻黄碱的总量不得少于0.80%。此外麻黄还含少量的甲基麻黄碱、甲基伪麻黄碱和去甲基麻黄碱、去甲基伪麻黄碱。槲皮素（B错）为银杏叶的主要化学成分，属于黄酮类化合物。银杏叶中的黄酮类化合物有黄酮、黄酮醇及其苷类、双黄酮和儿茶素类等。《中国药典》以总黄酮醇苷和萜类内酯为指标成分进行含量测定。要求总黄酮醇苷不少于0.4%，对照品采用槲皮素、山柰素和异鼠李素；要求萜类内酯不少于0.25%，对照品采用银杏内酯A、银杏内酯B、银杏内酯C和白果内酯。到目前为止，已从银杏叶中分离出20多个黄酮类化合物，其结构大体可分为山柰酚类、槲皮素类、木犀草素、二粒小麦黄酮、儿茶素类和双黄酮类。小檗碱（C错）为黄连的主要化学成分，属于异喹啉类生物碱。黄连的有效成分主要是生物碱，已经分离出来的生物碱有小檗碱（含量最高）、巴马汀、黄连碱、甲基黄连碱、药根碱和木兰碱（属于阿朴啡型）等；大多属苄基异喹啉类衍生物，季铵型生物碱。《中国药典》以小檗碱为指标成分进行含量测定。以盐酸小檗碱计，要求味连含小檗碱不得少于5.5%，表小檗碱不得少于0.80%，黄连碱不得少于1.6%，巴马汀不得少于1.5%；要求雅连含小檗碱不得少于4.5%；要求云连含小檗碱不得少于7.0%。青蒿素（E错）为青蒿的主要化学成分，属于倍半萜类化合物。单环倍半萜青蒿素是从中药青蒿（黄花蒿）中分离得到的具有过氧结构的倍半萜内酯，有很好的抗恶性疟疾活性，其多种衍生物制剂己用于临床。